2005年甲市男性人口的预期寿命为71岁，乙市男性人口的预期寿命为73岁，可以将甲、乙两地男性人口的预期寿命直接进行比较的原因是预期寿命不受人口
A. 总数量的影响
B. 死亡率的影响
C. 疾病构成的影响
D. 性别构成的影响
E. 年龄构成的影响

正确答案：E。年龄构成的影响